女性，32岁。病人表现紧张恐惧，坐立不安，有大祸临头之感，惶惶不可终日，说不出具体原因属于
A. 焦虑
B. 恐惧
C. 情感爆发
D. 易激惹
E. 情感不稳

正确答案：A。焦虑

解析：该病人不明原因的表现为紧张恐惧，坐立不安，有大祸临头之感，惶惶不可终日，为焦虑的临床表现（A对）。恐惧患者以过分和不合理地惧怕外界某种客观事物（黑暗、雷电）或情境（公众场合发表演讲）为主要表现，明知这种恐惧反应是过分的或不合理的，但仍反复出现，与本例不符（B错）。易激惹是情感活动的激惹性增高，表现为极易因一般小事而引起强烈的不愉快情感反应，如暴怒发作（D错）。情感不稳是情感活动的稳定性障碍，表现为患者的情感反应极易发生变化，从一个极端波动至另一极端，显得喜怒无常，变化莫测（E错）。